女，23岁。2天前不慎感寒后出现喘逆上气，胸胀而痛，鼻翕，咳吐黄稠痰，恶寒无汗，身痛口渴，苔黄质红，脉浮数诊断为
A. 风热型咳嗽
B. 痰热型咳嗽
C. 痰热郁肺型喘证
D. 表寒里热型喘证
E. 热哮

正确答案：D。表寒里热型喘证

解析：本病患者为喘证，寒邪束表，热郁于肺，肺气上逆。因寒邪束表，肺有郁热，或表寒未解，内已化热，热郁于肺，肺气上逆，而喘逆，息粗，鼻煽，胸部胀痛，咳痰稠粘不爽，热为寒郁则伴形寒、发热、烦闷、身痛。苔薄白或黄，质红，脉浮数为表寒肺热夹杂之象，所以诊断为表寒里热型喘证（D对）；风热型咳嗽症见咳嗽，咯痰不爽，痰黄或黏稠，喉燥咽痛，常伴恶风身热，头痛肢楚，鼻流黄涕，口渴等表证，舌苔薄黄，脉浮数或滑数（A错）；痰热型咳嗽症见咳嗽气息急促，或喉中有痰声，痰多黏稠或为黄痰，咳吐不爽，或痰有热腥味，或咳吐血痰，胸胁胀满，或咳引胸痛，面赤，或有身热，口干欲饮，舌质红，舌苔薄黄腻，脉滑数（B错）；痰热郁肺型喘证症见喘咳气涌，胸部胀痛，痰多粘稠色黄或夹血色，伴有胸中烦热，身热，有汗，口渴喜冷饮，面红，咽干，尿赤，大便或秘，苔黄或腻，脉滑数（C错）；热哮证症见气粗息涌，咳呛阵作，喉中哮鸣，胸高胁胀、烦闷不安，汗出口渴喜饮，面赤口苦，咳痰色黄或色白，黏浊稠厚，咯吐不利，不恶寒。舌质红，苔黄腻，脉滑数或弦滑（E错）。